可用于复凝聚法制备微囊的材料是
A. 阿拉伯胶-琼脂
B. 西黄蓍胶-阿拉伯胶
C. 阿拉伯胶-明胶
D. 西黄蓍胶-果胶
E. 阿拉伯胶-羧甲基纤维素钠

正确答案：C。阿拉伯胶-明胶